女，16岁，月经不规律，近半年月经量增多，无痛经，基础体温单相型，盆腔B超子宫及双附件阴性
A. 子宫内膜炎
B. 黄体功能不良
C. 黄体萎缩不全
D. 无排卵性子宫异常出血
E. 子宫腺肌病

正确答案：D。无排卵性子宫异常出血

解析：该患者女，16岁，月经不规律，近半年月经量增多，无痛经，基础体温单相型，盆腔B超子宫及双附件阴性，结合患者的表现和辅助检查，诊断为无排卵性子宫异常出血（D对）。子宫感染包括急性子宫内膜炎、子宫肌炎。病原体经胎盘剥离面侵入，扩散至子宫蜕膜层称为子宫内膜炎，侵入子宫肌层称为子宫肌炎，两者常伴发。若为子宫内膜炎，子宫内膜充血、坏死，阴道内有大量脓性分泌物且有臭味（A错）。不孕症或异常子宫出血患者应选在月经前或月经来潮6小时内刮宫，以判断有无排卵或黄体功能不良（B错）。月经来潮日血孕酮仍高于生理水平，提示黄体萎缩不全（C错）。子宫腺肌病 主要症状是月经改变和进行性痛经（E错）。以上四种疾病未出现基础体温呈单相型的表现，故除外。